同时具有吸附性能和分子筛性能的吸附剂是
A. 聚酰胺
B. 离子交换树脂
C. 硅胶
D. 大孔吸附树脂
E. 膜

正确答案：D。大孔吸附树脂

解析：本题考查的是大孔树脂吸附法。同时具有吸附性能和分子筛性能的吸附剂是大孔吸附树脂（D对）。大孔吸附树脂为大孔树脂吸附法的吸附剂，通常分为非极性和极性两大类。大孔吸附树脂的吸附原理：大孔吸附树脂具有选择性吸附和分子筛的性能。它的吸附性是由于范德华引力或产生氢键的结果，分子筛的性能是由其本身的多孔性网状结构决定的。聚酰胺（A错）为聚酰胺吸附色谱法的吸附剂。聚酰胺吸附色谱法：聚酰胺吸附属于氢键吸附，力量较弱，介于物理吸附与化学吸附之间，也称半化学吸附。离子交换树脂（B错）为离子色谱法的固定相。离子色谱法是根据物质解离程度不同进行分离。离子色谱法也称离子交换法，该法系以离子交换树脂作为固定相，以水或含水溶剂作为流动相。当流动相流过交换柱时，溶液中的中性分子及具有与离子交换树脂交换基团不能发生交换的离子将通过柱子从柱底流出，而具有可交换的离子则与树脂上的交换基因进行离子交换并被吸附到柱上，随后改变条件，并用适当溶剂从柱上洗脱下来，即可实现物质分离。硅胶（C错）为硅胶吸附色谱法的吸附剂。硅胶吸附色谱法：是根据物质的吸附性差别进行分离的方法。属于物理吸附。膜（E错）应用于膜分离法中。膜分离法是一种用天然或人工合成的膜，以外界能量或化学位差为推动力，对双组分或多组分的溶质和溶剂进行分离、分级、提纯或富集的方法。目前，膜过滤技术主要包括渗透、反渗透、超滤、电渗析和液膜技术等。